下列因素可以影响社区卫生服务需求的是
A. 社区卫生服务的质量
B. 卫生服务的价格
C. 居民的健康观念
D. 费用的支付方式
E. 以上都是

正确答案：E。以上都是

解析：本题考查社区卫生服务需求的影响因素。社区卫生服务需求的影响因素包括：社区卫生服务的质量、卫生服务的价格、居民的健康观念和费用的支付方式等。本题中以上均是（E对ABCD错）社区卫生服务需求的影响因素。